不能用普萘洛尔治疗的是
A. 心力衰竭
B. 高血压
C. 甲亢
D. 心律失常
E. 心绞痛

正确答案：A。心力衰竭

解析：本题考查普萘洛尔。不能用普萘洛尔治疗的是心力衰竭（A错，为本题正确答案）。普萘洛尔禁用于支气管哮喘、心源性休克、心脏传导阻滞（二至三度房室传导阻滞）、重度或急性心力衰竭、窦性心动过缓的患者。普萘洛尔普萘洛尔用于治疗各种程度的原发性高血压（B对），可单独使用，也可与其他抗高血压药合用。用于控制甲状腺功能亢进症的心率过快（C对），也可用于治疗甲状腺危象。控制室上性快速心律失常（D对）、室性心律失常，特别是与儿茶酚胺有关或洋地黄引起心律失常。可用于洋地黄疗效不佳的房扑、房颤心室率的控制，也可用于顽固性期前收缩，改善患者的症状。普萘洛尔可治疗稳定型及不稳定型心绞痛（E对），可减少发作次数，对兼患高血压或心律失常者更为适用。